中药饮片的剂量往往因疾病种类、病情轻重、用药目的不同而呈现不同特征。关于白芍使用目的与剂量的说法，正确的
A. 用于缓急止痛时，用量偏大
B. 用于平抑肝阳时，用量偏小
C. 用于平抑肝阳时，用量偏大
D. 用于柔肝健脾时，用量中等
E. 用于缓急止痛时，用量中等

正确答案：A。用于缓急止痛时，用量偏大

解析：本题考查的是中药饮片处方用药适宜性。中药饮片的剂量往往因疾病种类、病情轻重、用药目的不同而呈现不同特征。关于白芍使用目的与剂量的说法，正确的用于缓急止痛时，用量偏大（A对）。饮片处方药味数量和单味药剂量：饮片处方用药味数偏多、剂量偏大，不仅会增加患者的经济负担，还可能有潜在的安全隐患。处方药味应体现“君、臣、佐、使”的特性而不是简单的罗列，处方药味的多少和剂量的大小不是整齐划一和一成不变的，往往因疾病种类、病情轻重、用药目的、治疗思路、学术流派等的不同而呈现不同的特征。如白芍在起缓急止痛作用时用量偏大（E错），在起平抑肝阳作用时往往用量中等（BC错），在用于柔肝健脾时用量最小（D错）。又如柴胡在小柴胡汤中为君药，主透邪外出，用量大于其他药一倍有余；在逍遥散中主疏肝解郁为臣药，用量与各药相等；在补中益气汤中起升举清阳作用为佐药，用量偏小。对于毒性饮片和药性峻烈的饮片，药师在处方审核时应给予充分的关注，依据诊断判断其使用和剂量合理性，对于孕妇、儿童、老人以及肝肾功能不全等特殊患者更应谨慎使用。若确实需要超量使用则应由医生再次确认签字。